临终关怀的根本目的是为了
A. 节约卫生资源
B. 减轻家庭的经济负担
C. 提高临终患者的生存质量
D. 缩短患者的生存时间
E. 防止患者自杀

正确答案：C。提高临终患者的生存质量